某女，68岁。素患青光眼，刻下心悸不安，胸闷气短，动则尤甚，面色苍白，形寒肢冷，下肢浮肿，夜间不能平卧；舌淡苔白，脉虚弱。诊断为心悸。宜选用的中成药是
A. 人参归脾丸
B. 参松养心胶囊
C. 七叶神安片
D. 益心舒胶囊
E. 芪苈强心胶囊

正确答案：E。芪苈强心胶囊

解析：本题考查心悸之心阳不振证的常用中成药。结合患者症状为心悸之心阳不振证，宜选用芪苈强心胶囊（E对）。心悸之心阳不振证【症状】心悸不安，胸闷气短，动则尤甚，面色苍白，形寒肢冷。舌淡苔白，脉虚弱或沉细无力。【中成药应用】参仙升脉口服液、心宝丸、芪苈强心胶囊。心悸之心脾两虚证【症状】心悸气短，头晕目眩，失眠健忘，面色无华，倦怠乏力，纳呆食少。舌淡红，脉细弱。【中成药应用】人参归脾丸（A错）（大蜜丸）、复方扶芳藤合剂、益气养血口服液、消疲灵颗粒。心悸之瘀阻心脉证【症状】心悸不安，胸闷不舒，心痛时作，痛如针刺，唇甲青紫。舌质紫暗或有瘀斑，脉涩或结或代。【中成药应用】稳心颗粒、血府逐瘀口服液、七叶神安片（C错）、参松养心胶囊（B错）。胸痹之气阴两虚证【症状】胸闷隐痛，时作时止，心悸气短，动则益甚，伴倦怠懒言，易汗出，头晕，失眠多梦。舌红或淡红，舌体胖且边有齿痕，苔薄白或少，脉细缓或结代。【中成药应用】益心胶囊、益心舒胶囊（D错）、益心通脉颗粒、冠心生脉口服液、洛布桑胶囊。